根据《中华人民共和国行政复议法》，不属于可申请行政复议的情形是
A. 对行政机关作出的罚款、没收违法所得的行政行为不服的
B. 对行政机关作出的暂扣许可证的行政行为不服的
C. 对行政机关作出的行政处分不服的
D. 对行政机关作出的对财产的查封、扣押、冻结的行政行为不服的

正确答案：C。对行政机关作出的行政处分不服的

解析：本题考查的是行政复议的范围。根据《中华人民共和国行政复议法》，不属于可申请行政复议的情形是对行政机关作出的行政处分不服的（C错，为本题正确答案）。不可申请复议的事项：根据《行政复议法》第8条规定，下列两类事项不属于行政复议范围：（1）对行政机关作出的行政处分或者其他人事处理决定。（2）对民事纠纷的调解或者其他处理行为。可申请复议的具体行政行为：根据《行政复议法》第6条规定，公民、法人或者其他组织认为行政机关作出的具体行政行为属于下列情形之一的，可申请行政复议：（1）对行政机关作出的警告、罚款、没收违法所得、没收非法财物、责令停产停业、暂扣或吊销许可证、暂扣或吊销执照、行政拘留等行政处罚不服的（A对）。（2）对行政机关作出的限制人身自由或者对财产的查封、扣押、冻结等行政行为不服的（D对）。（3）对行政机关作出的有关许可证、执照、资质、资格等证书变更、终止、撤销的决定不服的（B对）。（4）对行政机关作出的关于确认土地、矿藏、水流、森林、山岭、草原、荒地、滩涂、海域等自然资源的所有权或者使用权的决定不服的。（5）认为行政机关侵犯合法的经营自主权的。（6）认为行政机关变更或者废止农村承包合同，侵犯其合法权益的。（7）认为行政机关违法集资、征收财物、摊派费用或者违法要求履行其他义务的。（8）认为符合法定条件申请行政机关颁发许可证、执照、资质证、资格证等证书，或者申请行政机关审批、登记有关事项，行政机关没有依法办理的。（9）申请行政机关履行保护人身权利、财产权利或者受教育权利的法定职责，行政机关没有依法履行的。（10）申请行政机关依法发放抚恤金、社会保险金或者最低生活保障费，行政机关没有依法发放的。（11）认为行政机关的其他具体行政行为侵犯其合法权益的。